梅毒的病原体是
A. 奋森密螺旋体
B. 苍白螺旋体
C. 牙密螺旋体
D. 白色念珠菌
E. 核梭杆菌

正确答案：B。苍白螺旋体

解析：本题考查梅毒的病原体。梅毒的病原体是苍白螺旋体（B对）。奋森密螺旋体（A错）是机会致病菌，可导致多种口腔感染。牙密螺旋体（C错）是口腔正常寄生菌群，大量繁殖可引起口腔感染。白色念珠菌（D错）属于真菌，可引起鹅口疮等感染。核梭杆菌（E错）存在于人的口腔，偶见于泌尿生殖道，可引起人的口腔感染、肺脓肿或胸膜肺部感染，与奋森氏密螺旋体共同致奋森氏咽峡炎等。